mRNA碱基缺失或插入可引起框移突变是由于密码的
A. 连续性
B. 特异性
C. 通用性
D. 摆动性
E. 简并性

正确答案：A。连续性

解析：本题考查遗传密码的特点。mRNA碱基缺失或插入可引起框移突变是由于密码的连续性（A对）。遗传密码的特点包括方向性、连续性、简并性、摆动性、通用性，不包括特异性（B错）。通用性（C错）是指从细菌到人类都使用着同一套遗传密码。摆动性（D错）是指密码子的翻译与tRNA的反密码子的配对有时并不严格遵循Watson-Crick碱基配对原则。简并性（E错）是指有的氨基酸可有多个密码子编码。